视黄醇当量是指
A. 维生素A₁的量
B. 维生素A₂的量
C. 体内具有维生素A活性物质的总量
D. β-胡萝卜素的量
E. 其他维生素A原的量

正确答案：C。体内具有维生素A活性物质的总量